患者久病湿疹，面垢多眵，大便溏泄，时发下痢脓血，小溲浑浊不清，湿疹浸淫流水，舌苔白厚腻，脉濡滑。病属湿邪为患，此证反映了湿邪的哪种性质
A. 重着
B. 黏腻
C. 趋下
D. 秽浊
E. 类水

正确答案：D。秽浊

解析：面垢多眵符合湿浊在上则面垢、眵多的表现，大便溏泄，时发下痢脓血符合湿滞大肠，则大便溏泄、下痢脓血的表现，小溲浑浊不清符合湿浊下注，则小便浑浊、妇女白带过多的表现，湿邪侵淫肌肤，则可见湿疹侵淫流水。由此可以得出本题表现了湿邪秽浊的性质（D对）。题目中没有沉重感的表现，所以没有体现湿性重浊的性质（A错），没有黏滞而不爽的表现和病程缠绵的表现，所以没有体现湿的粘滞性的特点（B错）。因为题中没有给出给出湿邪伤及人体下部表现，所以没有体现湿性趋下的特点（CE错）。